某年某社区开展为期一年的糖尿病普查，该社区年初人口数9500人，年末人口数10500人。年初有糖尿病患者100人，年末有糖尿病患者130人，普查期间有10名患者死于糖尿病并发症。该社区普查当年的糖尿病病死率
A. 10/10500
B. 10/10000
C. 10/140
D. 10/130
E. 10/40

正确答案：C。10/140